雷尼替丁服后可能导致
A. 黑色大便
B. 口干和视力模糊
C. 便秘
D. 幻觉、定向力障碍
E. 疲乏、嗜睡

正确答案：D。幻觉、定向力障碍

解析：本题考查雷尼替丁的不良反应。雷尼替丁为组胺H₂受体阻断剂，不良反应有头痛、恶心、皮疹、便秘、乏力、产生幻觉、定向力障碍（D对）等。